男，40岁，腰部扭伤后疼痛伴右下肢麻木1周，咳嗽时加剧，查体：L4～L5棘突间压痛，右侧直腿抬高试验30°（+），右小腿外侧感觉迟钝，母趾背伸5级，腱反射正常，首选治疗
A. 微创手术
B. 开放手术
C. 封闭针
D. 加强腰肌锻炼
E. 严格卧床休息，非甾体抗炎药物治疗

正确答案：E。严格卧床休息，非甾体抗炎药物治疗

解析：中年男性患者，腰部扭伤后（诱因）疼痛伴右下肢麻木1周，咳嗽时加剧（腰间盘突出症表现），查体：L4-L5棘突间压痛，右侧直腿抬高试验30度（+）（直腿抬高试验强阳性，提示腰间盘突出症），右小腿外侧感觉迟钝，母趾背伸5级（结合L4-L5棘突间压痛，定位在L5神经根），腱反射正常，故患者考虑诊断腰间盘突出症。患者初次发病，且病程较短，故首选非手术治疗，即严格卧床休息，非甾体抗炎药物治疗（E对）。微创手术（A错）、开放手术（B错）一般适用于以下情况：①腰腿痛症状严重，反复发作，经半年以上非手术治疗无效，且病情逐渐加重，影响工作和生活者；②中央型突出有马尾神经综合征，括约肌功能障碍者，应按急诊进行手术；③有明显的神经受累表现者。封闭针（C错）适用于腰间盘突出有明确压痛点的患者。加强腰肌锻炼（D错）一般适用于腰椎间盘突出患者疼痛缓解期的治疗。